一谷物的赖氨酸评分为0.42，苏氨酸0.70，蛋氨酸1.04，缬氨酸0.96，色氨酸1.10。该谷物的限制氨基酸是
A. 色氨酸
B. 缬氨酸
C. 苏氨酸
D. 赖氨酸
E. 蛋氨酸

正确答案：D。赖氨酸